卵巢内胚窦瘤的特异性肿瘤标志物是
A. AFP
B. CA125
C. hCG
D. PSA
E. CA19-9

正确答案：A。AFP

解析：卵巢内胚窦瘤的特异性肿瘤标志物是AFP（A对），对其诊断及病情监测有重要意义。CA125（P324）（B错）是诊断卵巢上皮性癌价值最大的肿瘤标志物。hCG（C错）的检查对早期妊娠诊断有重要意义，对与妊娠相关疾病、滋养细胞肿瘤等疾病的诊断、鉴别和病程观察等有一定价值，还对非妊娠性卵巢绒癌有特异性。PSA（前列腺特异抗原）（D错）是前列腺癌的特异性标志物。CA19-9（E错）是胰腺癌和结、直肠癌的肿瘤标志物。